不适于降压治疗原则的是
A. 提高生活质量
B. 改善生活行为
C. 降压药治疗对象
D. 多重心血管危险因素协同控制
E. 降压药物种类

正确答案：A。提高生活质量

解析：降压治疗原则：①改善生活行为；②明确降压药治疗对象；③多重心血管危险因素协同控制；④合理使用降压药物。掌握“原发性高血压”知识点。